女，7个月。体重5.5Kg。母乳喂养，量少，未加辅食。体检：神志清，精神可，稍苍白，腹部皮下脂肪0.5cm，肌肉稍松弛。可能诊断是
A. 正常儿
B. Ⅰ度营养不良
C. Ⅱ度营养不良
D. Ⅲ度营养不良
E. 佝偻病

正确答案：C。Ⅱ度营养不良

解析：该患儿体重为5.5kg（正常7月儿的体重为7.75kg左右），另外有神志清、稍苍白、腹部皮下脂肪0.5cm、肌肉稍松弛的临床表现，应诊断为营养不良，在结合患者腹部皮下脂肪的结果，提示该患儿是Ⅱ度营养不良（C对BD错）。该患儿已有体重下降、腹部皮下脂肪减少得表现，不可能是正常儿（A错）。佝偻病的患儿一定会有骨骼方面的改变，与该患儿的临床表现不符，可以排除佝偻病（E错）。按体重：Ⅰ度：体重低于正常均值15%～25%；Ⅱ度：体重低于正常均值25%～40%；Ⅲ度：体重低于正常均值40%～60%。腹部皮下脂肪是重要的分度标准：Ⅰ度营养不良皮下脂肪为0.4～0.8cm。Ⅱ度营养不良皮下脂肪为0.4cm以下。Ⅲ度营养不良皮下脂肪消失。判断等级就重不就轻。